下列哪项不是常用的已知职业性有害因素的识别和筛选方法
A. 类比法
B. 检查表法
C. 职业流行病学调查
D. 工程分析法
E. 经验法

正确答案：C。职业流行病学调查